患者男性，55岁，因右上颌牙痛三天，右侧眼下、鼻侧肿胀一天而就诊。检查：右侧上颌尖牙远中深龋，探（-），叩（++），松动（-），前庭沟肿胀变浅，同侧鼻侧、眶下区肿胀明显，局部皮温增高，压痛和波动感存在，眼裂变小。体温40℃，食欲下降，精神萎靡。该患者最有可能的诊断为右侧眶下间隙感染，最可能的直接病因为
A. 右上颌尖牙牙周炎
B. 右上颌尖牙髓炎
C. 右上颌尖牙根尖周炎
D. 右上颌窦炎

正确答案：C。右上颌尖牙根尖周炎

解析：本题考查眶下间隙感染的感染来源。眶下间隙感染多来自上颌尖牙，第一前磨牙和上颌切牙的根尖化脓性炎症和牙槽脓肿（C对）。牙周炎（A错）的主要临床表现为牙龈炎症、真性牙周袋、附着丧失、牙槽骨吸收及病变不可逆，破坏的支持组织不能完全恢复正常。牙髓炎（B错）的病变范围局限于牙髓组织，晚期可波及根尖部的牙周膜。上颌窦炎（D错）为持续性胀痛，伴有头痛、鼻塞、脓涕等上呼吸道感染的症状，体位突然改变牙痛加重，上颌窦前壁有压痛。